男，44岁，建筑工人，6小时前不慎从高处坠落摔伤，腰部疼痛，活动受限，不能站立行走。为明确神经损伤情况，首选的检查是
A. 肌电图
B. CT
C. MRI
D. ECT
E. B超

正确答案：C。MRI

解析：患者高处坠落后，腰部疼痛、活动受限（提示可能为腰椎骨折），不能站立行走（提示可能有脊髓损伤），结合患者病史和临床表现，该患者最可能的诊断为腰椎骨折合并脊髓损伤。为了明确神经损伤的情况，首选检查为MRI（C对）。MRI对软组织层次显示较好，可观察到脊髓及周围神经损伤的情况，还可了解脊髓受压程度、脊髓信号改变的范围和脊髓萎缩情况等。肌电图（A错）主要用于检查双下肢的神经肌肉功能。CT（B错）对于骨性结构显像较好，但对于脊髓等软组织显影差。ECT（D错）即发射型计算机断层扫描，主要用于较易发生骨转移癌症（如甲状腺癌、乳腺癌等）的检查。B超（E错）对脊柱骨折及脊髓损伤诊断意义不大。